上运动神经元瘫痪的体征是
A. 腱反射消失
B. 浅反射活跃
C. 肌张力降低
D. 肌肉萎缩明显
E. 病理征阳性

正确答案：E。病理征阳性

解析：上运动神经元瘫痪为大脑皮质运动区神经元及其发出的下行纤维病变所致，临床特点为瘫痪分布于整个肢体，肌张力增高（C错），肌力减弱，浅反射消失（B错），腱反射增强（A错），病理征阳性（E对），无肌萎缩或轻度废用性萎缩（D错），肌电图正常，多无皮肤营养障碍。